关于咽旁间隙感染途径的叙述不正确的是
A. 多为牙源性，特别是下颌智牙冠周炎
B. 腭扁桃体感染的扩散
C. 相邻间隙感染的扩散
D. 偶尔继发于腮腺炎
E. 常常继发于耳源性炎症和颈深上巴结炎

正确答案：E。常常继发于耳源性炎症和颈深上巴结炎

解析：咽旁间隙感染途径：多为牙源性，特别是下颌智牙冠周炎，以及腭扁桃体和相邻间隙感染的扩散。偶尔继发于腮腺炎耳源性炎症和颈深上巴结炎。掌握“颞间隙、咽旁间隙感染”知识点。